多氯联苯进入人体后，可蓄积在各个组织中，其中哪种组织中含量最高
A. 肝脏
B. 肾脏
C. 血液
D. 淋巴
E. 脂肪

正确答案：E。脂肪

解析：本题考查人体中多氯联苯含量最高的组织。多氯联苯是一类有毒有害的有机污染物，它们可以通过空气、水和食物进入人体，并在人体各个组织中蓄积，其中脂肪（E对ABCD错）组织中的含量最高。